属于适当合并用药的是
A. 给病人无根据地使用多种药物
B. 为减少药物不良反应而合并用药
C. 多名医生给同一病人开相同的药物
D. 并用含有相同活性成分的复方制剂
E. 提前续开处方造成同时使用相同的药物

正确答案：B。为减少药物不良反应而合并用药